欲计算2006年某地肝癌的发病率，其分母为2006年该地
A. 体检人数
B. 肝癌患者人数
C. 肝炎患者人数
D. 平均人口数
E. 平均就诊人数

正确答案：D。平均人口数